常见酶催化基团有
A. 羧基、羰基、醛基、酮基
B. 羧基、羟基、咪唑基、巯基
C. 羧基、羰基、酮基、酰基
D. 亚氨基、羧基、巯基、羟基
E. 羟基、羰基、羧基、醛基

正确答案：B。羧基、羟基、咪唑基、巯基

解析：酶活性中心的必需基团有两类，结合基团和催化基团。活性中心内的必需基团可同时具有这两方面的功能。组氨酸残基的咪唑基、丝氨酸残基的羟基、半胱氨酸残基的巯基以及谷氨酸残基的γ-羧基是构成酶活性中心的常见基团。掌握“酶的催化”知识点。